内毒素的毒性作用不引起
A. 食物中毒
B. 发热
C. 休克
D. DIC
E. 白细胞反应

正确答案：A。食物中毒